为维护医患之间相互信任的关系医师必须做到，但应除外
A. 主动赢得患者信任
B. 珍惜患者的信任
C. 对患者所提要求言听计从
D. 努力消除误解
E. 对患者出现的疑虑尽量澄清

正确答案：C。对患者所提要求言听计从

解析：从医患关系的技术方面来说，由于医方是技术上的内行，而患方是技术上的外行（特殊情况除外），因此在技术交往过程中，至少是医方主动提供医疗方案，然后由患方选择，但是，应当防范技术交往过程中家长式的粗暴作风，独断专行，去实施未征得患方同意的重大医疗措施。否则，可能会导致不应有的医疗纠纷。掌握“医患关系伦理”知识点。